从1岁到3岁以前
A. 胎儿期
B. 新生儿期
C. 婴儿期
D. 幼儿期
E. 学龄前期

正确答案：D。幼儿期

解析：本题考查小儿年龄分期。幼儿期（D对）：1周岁后到满3周岁之前。